患者女，40岁。寒战、发热、腰痛伴尿频、尿急4天。体温39℃，心肺无异常。肝脾肋下未触及。两侧肋脊角有叩击痛。尿液检查：蛋白（-），镜检红细胞2～5/HP、白细胞10～15/HP。诊断应首先考虑
A. 急性膀胱炎
B. 急性肾盂肾炎
C. 急性肾小球肾炎
D. 肾结核
E. 肾癌

正确答案：B。急性肾盂肾炎

解析：急性肾盂肾炎时常有寒战、发热、腰痛伴尿频、尿急，其中腰痛是急性肾盂肾炎所特有的。掌握“急性肾孟肾炎、尿路结石及慢性肾衰竭”知识点。